解剖牙冠与牙根交界处的弧形曲线为
A. 牙冠
B. 牙根
C. 牙颈
D. 釉牙本质界
E. 牙本质小管

正确答案：C。牙颈

解析：牙颈：指解剖牙冠与牙根交界处的弧形曲线。掌握“牙的组成、分类、功能及牙位记录”知识点。